关于横结肠正确的是
A. 为腹膜间位器官
B. 与小网膜相连
C. 肠管上无结肠带
D. 其静脉汇入下腔静脉
E. 由中结肠动脉供血

正确答案：E。由中结肠动脉供血

解析：横结肠为腹膜内位器官(A错)，其通过肠系膜连于腹后壁，不与小网膜相连(B错)，结肠袋，结肠带(C错)和肠脂垂为结肠和盲肠的特征性结构，横结肠静脉汇入肠系膜下静脉(D错)，横结肠系膜内含中结肠血管，即由中结肠动脉供血(E对)。